在药品管理中明确实施特殊管理的兴奋剂是
A. 胰岛素
B. 蛋白同化制剂
C. 利尿剂
D. 麻醉止痛剂

正确答案：D。麻醉止痛剂

解析：本题考查兴奋剂的管理层次。在药品管理中明确实施特殊管理的兴奋剂是麻醉止痛剂（D对）。在药品管理中明确实施特殊管理的兴奋剂是。（一）兴奋剂的管理层次：依照《反兴奋剂条例》的规定，我国对含兴奋剂药品的管理可体现为三个层次。1.实施特殊管理：兴奋剂目录所列禁用物质属于麻醉药品、精神药品、医疗用毒性药品和药品类易制毒化学品的，其生产、销售、进口、运输和使用，依照《药品管理法》和有关行政法规的规定实施特殊管理。2.实施严格管理：兴奋剂目录所列禁用物质属于我国尚未实施特殊管理的蛋白同化制剂（B错）、肽类激素的，依照《药品管理法》《反兴奋剂条例》的规定，参照我国有关特殊管理药品的管理措施和国际通行做法，其生产、销售、进口和使用环节实施严格管理。3.实施处方药管理：除上述实施特殊管理和严格管理的品种外，兴奋剂目录所列的其他禁用物质，实施处方药管理。药品零售企业必须凭处方销售胰岛素（A错）以及其他按规定可以销售的含兴奋剂药品。